甲状旁腺内贮存的激素
A. 位于甲状腺侧叶后面
B. 不对称，呈黄豆大小
C. 促甲状腺素
D. 促性腺激素
E. 促肾上腺皮质激素

正确答案：A。位于甲状腺侧叶后面

解析：甲状旁腺为棕黄色、黄豆大小的扁椭圆形腺体,位于甲状腺左、右侧叶的后面（A对），共两对，对称分布（B错），分泌甲状旁腺素和降钙素。促甲状腺素（C错）、促性腺激素（D错）、促肾上腺皮质激素（E错）等促激素是由垂体分泌的。